与人体生长发育关系最密切的是
A. 气的推动与调控作用
B. 气的固摄作用
C. 气的温煦作用
D. 气的防御作用
E. 气的气化作用

正确答案：A。气的推动与调控作用

解析：气的推动作用主要体现在：激发和促进人体的生长发育及生殖机能（A对）；激发和促进各脏腑经络的生理机能；激发和促进精血津液的生成及运行输布；激发和兴奋精神活动。气的防御作用是指气既能护卫肌表，防御外邪入侵，同时也可以祛除侵入人体内的病邪（D错）。气的固摄作用是指气对体内血、津液、精等液态物质的固护、统摄和控制作用，防止其无故流失，保证它们发挥正常的生理作用（B错）。气的温煦作用，指气中属阳部分（阳气）的促进产热，消除寒冷，使人体温暖的作用（C错）。气化主要是指由人体之气的运动而引起的精气血津液等物质与能量的新陈代谢过程（E错）。